下列关于零售企业计算机系统的说法，正确的是
A. 与票据开具系统对接，自动生成销售记录
B. 可自动拒绝含麻黄碱类复方制剂超数量销售
C. 可自动识别处方药、特殊管理的药品
D. 支持录入质量管理人员制定的陈列药品检查计划

正确答案：A、B、C、D。与票据开具系统对接，自动生成销售记录；可自动拒绝含麻黄碱类复方制剂超数量销售；可自动识别处方药、特殊管理的药品；支持录入质量管理人员制定的陈列药品检查计划

解析：本题考查药品经营企业计算机系统的主要规范内容。说法正确的有：与票据开具系统对接，自动生成销售记录（A对）；可自动拒绝含麻黄碱类复方制剂超数量销售（B对）；可自动识别处方药、特殊管理的药品（C对）；支持录入质量管理人员制定的陈列药品检查计划（D对）。药品零售企业系统应建立包括供货单位、经营品种等相关内容的基础数据，自动识别处方药、特殊管理的药品以及其他国家有专门管理要求的药品，可自动拒绝国家有专门管理要求的药品超数量销售；系统与结算系统、开票系统对接，对每笔销售自动打印销售票据，并自动生成销售记录；系统对拆零药品实施安全、合理的销售控制，单独建立拆零药品销售记录；系统能定期自动生成陈列药品检查计划，对药品有效期进行跟踪，实现近效期预警、超有效期自动锁定及停销功能，各类数据的录入与保存符合药品GSP相关要求。